侵袭性牙周炎包括
A. 青少年牙周炎
B. 早发性牙周炎
C. 青春前期牙周炎
D. 快速进展性牙周炎
E. 以上均正确

正确答案：E。以上均正确

解析：青少年牙周炎、快速进展性牙周炎和青春前期牙周炎，这三个类型曾合称为早发性牙周炎。在1999年的国际研讨会上建议更名为侵袭性牙周炎。掌握“侵袭性牙周炎”知识点。